低钾血症错误的临床表现是
A. 肌无力为最早的临床表现
B. 均有典型的心电图改变
C. 常与镁缺乏同时存在
D. 严重时可发生多尿
E. 发生碱中毒时尿呈酸性

正确答案：B。均有典型的心电图改变

解析：低钾血症典型的心电图改变为早期出现T波降低、变平或倒置，随后出现ST段降低、QT间期延长和U波。但并非每个病人都有心电图改变（B错，为本题正确答案）。肌无力为低钾血症最早的临床表现（A对），先表现四肢软弱无力，然后累及躯干和呼吸肌，可导致呼吸困难甚至窒息。临床上低钾血症常与镁缺乏同时存在（C对）。醛固酮的作用是保水保钠排钾，严重的低钾血症会抑制醛固酮的分泌，使肾远端小管重吸收钠离子和水减少，从而发生多尿（D对）。低钾血症可致代谢性碱中毒，这是由于一方面K⁺由细胞内移出，与Na⁺、H⁺的交换增加，使细胞外液的H⁺浓度降低；另一方面，远曲肾小管Na⁺、K⁺交换减少，Na⁺、H⁺交换增加，使排H⁺增多，这两方面的作用导致了低钾性碱中毒的发生。此时，由于尿中H⁺量增多，尿呈酸性，即反常性酸性尿（E对）。